保存期内的全血最主要的有效成分是
A. 红细胞
B. 白细胞
C. 血小板
D. 凝血因子
E. 免疫球蛋白

正确答案：A。红细胞

解析：目前，我国大部分血站完成血液采集后，所采用的全血的保存的条件都是针对红细胞来设计的，但对于白细胞（B错）、血小板（C错）、凝血因子（D错）及免疫球蛋白（E错）等其他的血液成分是不合适的，因此在全血的保存过程中，红细胞是保存期内的全血最主要的有效成分（A对）。